女，28岁。间断下腹痛4年余，大便2～3次/日，稀便，无脓血，便后下腹痛可缓解。粪常规检查：未见细胞，隐血试验阴性，查体无异常发现。该患者最适合的治疗药物是
A. 柳氮磺胺吡啶
B. 喹诺酮类抗生素
C. 泼尼松龙
D. 异烟肼
E. 匹维溴铵

正确答案：E。匹维溴铵

解析：该患者诊断为肠易激综合征，主要症状为腹痛，可使用匹维溴铵（E对）对症治疗。匹维溴铵为选择性作用于胃肠道平滑肌的钙通道阻滞剂，对腹痛有一定疗效，且不良反应少。柳氮磺胺吡啶（A错）、泼尼松龙（C错）是治疗炎症性肠病的常用药（P376）。喹诺酮类抗生素（B错）对肠易激综合征无效。异烟肼（D错）为抗结核药，可用于治疗肠结核。